上后牙3/4冠邻沟的方向为
A. 与颊面（牙合）2/3平行
B. 与颊面龈1/3平行
C. 与轴壁平行
D. 与舌面平行
E. 以上都不是

正确答案：C。与轴壁平行

解析：本题考查后牙3/4冠邻沟的方向。邻沟（邻面轴沟）要保证与就位道平行以利于修复体顺利就位，而就位道是与轴壁平行的，所以邻沟与轴壁平行（C对）。与颊面（牙合）2/3平行（A错）、与颊面龈1/3平行（B错）、与舌面平行（D错）都不能保持和就位道的平行，修复体无法就位，是错误的。